在调查过程中样本人群的选择是随意选择，破坏了同质性，使调查结果与总体人群患病情况之间产生的误差，称为
A. 无应答偏倚
B. 标准误差
C. 选择性偏倚
D. 决定性偏倚
E. 测量误差

正确答案：C。选择性偏倚

解析：在调查过程中样本人群的选择不是按照抽样设计的方案进行，而是随意选择，由于调查对象的代表性差，破坏了同质性，使调查结果与总体人群患病情况之间产生的误差，称为选择性偏倚。掌握“口腔健康状况调查的样本含量及误差”知识点。